药用部位为雌虫干燥体的药材是
A. 牛黄
B. 土鳖虫
C. 海螵蛸
D. 桑螵蛸
E. 蟾酥

正确答案：B。土鳖虫

解析：本题考查的是土鳖虫的来源。药用部位为雌虫干燥体的药材是土鳖虫（B对）。土鳖虫【来源】为节肢动物门昆虫纲鳖蠊科昆虫地鳖或冀地鳖的雌虫干燥体。牛黄（A错）【来源】为脊索动物门哺乳纲牛科动物牛干燥的胆结石。习称“天然牛黄”。海螵蛸（C错）【来源】为软体动物门乌贼科动物无针乌贼或金乌贼 的干燥内壳。桑螵蛸（D错）【来源】为节肢动物门昆虫纲螳螂科昆虫大刀螂、小刀螂 或巨斧螳螂的干燥卵鞘，以上三种分别习称“团螵蛸”“长螵蛸”及“黑螵蛸”。蟾酥（E错）【来源】为脊索动物门两栖纲蟾蜍科动物中华大蟾蜍或黑眶蟾蜍耳后腺及皮肤腺的干燥分泌物。